霍乱流行的最重要的传播形式是通过
A. 食物
B. 水
C. 生活接触
D. 苍蝇媒介
E. 呼吸道

正确答案：B。水

解析：霍乱流行传播途径主要是通过污染的水源或食物经口摄入，经污染鱼、虾等水产品引起传播，其中最重要的传播形式是通过水（B对A错），污染的水源或食物经口摄入可引起霍乱爆发流行，导致人类轻型腹泻甚至是严重致死性腹泻。日常生活接触（C错）和苍蝇（D错）也起传播作用，但不是最重要的传播形式（八版传染病学P172）。呼吸道传播（E错）不是霍乱弧菌的传播形式。